糖尿病酮症的治疗原则错误的是
A. 较小量胰岛素持续静滴
B. 立即补液纠正补水
C. 尽早应用碱性液迅速纠正酸中毒
D. 见尿后补钾
E. 去除诱因，控制感染

正确答案：C。尽早应用碱性液迅速纠正酸中毒

解析：糖尿病酮症的治疗原则为尽快补液及恢复血容量、纠正失水状态（B对）；降低血糖：一般采用小剂量胰岛素治疗方案，将短效胰岛素加入生理盐水中持续静脉滴注（A对），亦可间歇静脉注射；纠正电解质及酸碱平衡失调：本症酸中毒主要由酮体中酸性代谢产物引起，经输液和胰岛素治疗后，酮体水平下降，酸中毒可自行纠正，一般不必补碱（C错，为本题正确答案）。糖尿病酮症患者有不同程度失钾，可根据血钾和尿量补钾（D对）；同时积极寻找和消除诱因（E对），防止并发症，降低病死率。